属于超短效胰岛素/胰岛素类似物的是
A. 精蛋白锌胰岛素
B. 甘精胰岛素
C. 普通胰岛素
D. 门冬胰岛素
E. 低精蛋白锌胰岛素

正确答案：D。门冬胰岛素

解析：本题考查胰岛素/胰岛素类似物的分类。门冬胰岛素（D对）属于超短效胰岛素。胰岛素及胰岛素类似物根据胰岛素作用时间分类：（1）超短效胰岛素：门冬胰岛素、赖脯胰岛素。（2）短效胰岛素：主要有动物来源和重组人胰岛素来源两种。又称为“可溶性胰岛素”、“常规胰岛素”、“中性胰岛素”。（3）中效胰岛素：最常见是低精蛋白锌胰岛素（E错）。（4）长效胰岛素：最常见的就是精蛋白锌胰岛素（A错）。（5）超长效胰岛素：甘精胰岛素（B错）和地特胰岛素。（6）预混胰岛素：即“双时相胰岛素”，是指含有两种胰岛素的混合物，可同时具有短效和长效胰岛素的作用。